儿童期对蛋白质和热能的需要按每千克体重计算是
A. 年龄越小需要的越少
B. 年龄越小需要的越多
C. 不论年龄，每千克体重均一样
D. 与成人一样
E. 多于成年人

正确答案：B。年龄越小需要的越多